女，27岁。后仰摔倒左枕部着地，伤后昏迷。检查发现患者左枕部头皮血肿，右侧瞳孔5mm，光反射消失，左侧瞳孔2mm，左侧肢体偏瘫，右侧肢体有自主动作。正确诊断是
A. 左额颞硬膜下血肿并脑疝
B. 左额颞硬膜外血肿并脑疝
C. 左枕头皮血肿并右额颞硬膜外血肿
D. 左枕头皮血肿并左额颞硬膜下血肿
E. 右额颞硬膜下血肿并脑疝

正确答案：E。右额颞硬膜下血肿并脑疝

解析：根据颅脑对冲伤的受伤机制（损伤发生在着力部位的对侧），患者左枕部着地导致右额颞叶损伤，受伤后立即昏迷，没有中间清醒期（硬脑膜下血肿多表现为持续昏迷），双眼瞳孔不等大（脑疝表现为瞳孔大小不一），肢体偏瘫（硬脑膜下血肿伤后立即出现偏瘫等征象），故诊断为右额颞硬膜下血肿并脑疝（E对AD错）。硬膜外血肿（BC错）有典型的中间清醒期（即受伤-昏迷-清醒-再昏迷）。